王某，24岁，患慢性淋病，小便不畅，短涩，淋沥不尽，腰酸腿软，五心烦热疲劳易发，食少纳差，白带增多，舌淡边有齿痕，苔白腻，脉沉细弱。其证候是
A. 湿热毒蕴
B. 阴虚毒恋
C. 毒邪流窜
D. 热毒入络
E. 脾虚湿蕴

正确答案：B。阴虚毒恋

解析：慢性淋病病程日长，耗伤正气，正气虚弱，无力驱毒外出，形成正虚毒恋之证，除了可见淋病的尿道刺痛、尿道口排出脓性分泌物的主要表现，还可见到一派阴虚之象如腰酸腿软，五心烦热，疲劳易发，食少纳差，白带增多，舌淡有齿痕，苔白腻，脉沉细弱（B对）。若为湿热毒蕴，应可见四肢困重，纳呆，口苦黏腻，小便黄，大便黏腻，舌红苔黄腻，脉滑数（A错）。若为毒邪流窜可见此处未愈它处又发，或引发它症（C错）。若为热毒入络可见脉络红肿焮热伴全身高热、口渴等（D错）。若为脾虚湿蕴应见四肢无力，面色㿠白，纳呆，便溏，舌淡苔白，脉细弱（E错）。